疑为宫外孕破裂，最常用的辅助检查方法是
A. 妊娠试验
B. B超
C. 阴道后穹隆穿刺
D. 腹腔镜检查
E. 诊断性刮宫

正确答案：C。阴道后穹隆穿刺

解析：宫外孕已破裂期腹腔内大量出血，出现休克，阴道后穹隆穿刺（C对）可明确诊断腹腔内情况，为异位妊娠破裂的常用辅助检查。妊娠试验（A错）能检测出妊娠状态，不能诊断宫外孕破裂。B超（B错）可了解宫腔内有无孕囊，附件部位有无包块及盆腹腔内有无积液，有助于诊断异位妊娠，但宫外孕破裂腹腔大量出血时，B超检查不准确。腹腔镜检查（D错）适用于早期输卵管妊娠尚未破裂的患者，若腹腔内大量出血或伴休克者，禁止做腹腔镜检查。诊断性刮宫（E错）目前仅适用于阴道流血较多的病例，不是常用辅助方法。